诊断胎儿遗传性疾病，准确性较差的产前诊断技术是
A. 孕妇血提取胎儿细胞
B. 羊水穿刺
C. 胎儿镜下活检
D. 经皮脐血穿刺技术
E. 绒毛穿刺取样

正确答案：A。孕妇血提取胎儿细胞

解析：妊娠过程中，少许胎儿细胞可经胎盘循环进入母亲血液中，经孕妇血提取胎儿细胞（A错，为本题正确答案）可进行产前检查，此为无创间接手段获取胎儿细胞，可存在误差，准确性较差。羊水穿刺（B对）一般在妊娠14～20周进行，在B超引导下，抽取少量羊水进行染色体检查；胎儿镜下活检（C对）是通过0.5～3mm光纤内镜进入羊膜腔内观察胎儿，并可采取羊水、胎儿血、胎儿体表组织进行遗传学检查；经皮脐血穿刺技术（D对）是在B超引导下，穿刺脐血管抽取少量脐血进行染色体核型分析；绒毛穿刺取样（E对）是妊娠10～13周在B超引导下，用穿刺针穿过孕妇的腹壁刺入宫腔吸出少许绒毛进行检查，是用于确诊胎儿是否有染色体异常、神经管缺陷以及某些能在羊水中反映出来的遗传性代谢疾病。后四种皆为直接获取胎儿成分，相较A而言准确性更高。